结构为去甲睾酮的衍生物，具有孕激素样作用的药物是
A. 苯丙酸诺龙
B. 雌二醇
C. 炔雌醇
D. 雌酮
E. 炔诺酮

正确答案：E。炔诺酮

解析：本题考查炔诺酮的结构及药理作用。炔诺酮（E对）为去甲睾酮的衍生物，具有孕激素样作用，口服有效，抑制排卵作用强于黄体酮。